证见身常汗出，夜卧尤甚，久而不止，心悸惊惕，短气烦倦者，应选用方剂为
A. 补中益气汤
B. 四物汤
C. 牡蛎散
D. 归脾汤
E. 黄土汤

正确答案：C。牡蛎散

解析：本证因卫外不固，阴液损伤，心阳不潜所致。卫气虚，卫外不固，腠理疏松，津液外泄则身常汗出；汗为心液，汗出过多，心阴不足，心阳不潜，虚热内生，阴津外泄，故汗出、夜卧更甚；汗出日久，心之气阴耗伤，心神失养，则见心悸易惊、烦倦短气。治宜用益气固表，敛阴止汗的牡蛎散（C对）。补中益气汤（A错）的功用为补中益气，升阳举陷，主治脾胃气虚证；气虚下陷证；气虚发热证。四物汤（B错）的功用为补血和血，主治营血虚滞证。归脾汤（D错）的功用为益气补血，健脾养心，主治心脾气血两虚证；脾不统血证。黄土汤（E错）的功用为温阳健脾，养血止血，主治脾阳不足，脾不统血证。